根据一个区域历年积累的环境资料进行综合分析和评价，用以发现和评价该区域环境质量的发展变化过程称为
A. 环境质量现状评价
B. 回顾性环境质量评价
C. 环境影响评价
D. 总环境质量评价
E. 单因素环境质量评价

正确答案：B。回顾性环境质量评价